患者女性，54岁，被鱼刺刺伤右手示指指尖两天，出现手指端针刺样疼痛、肿胀就诊，患指剧痛、肿胀明显。首先应考虑
A. 蜂窝织炎
B. 脓性指头炎
C. 脓肿
D. 痈
E. 甲沟炎

正确答案：B。脓性指头炎

解析：患者右手示指尖刺伤史2天，出现手指端针刺样疼痛、肿胀，考虑右手示指脓性指头炎（多因指尖、手指末节皮肤受伤后引起，初起有针刺样痛，轻度肿胀）（B对）。甲沟炎（E错）是皮肤沿指甲两侧形成的甲沟及其周围组织的化脓性细菌感染，常发生在一侧甲沟皮下。